某患者因肺炎就医，经皮试注射青霉素后出现全身荨麻疹，属于
A. 迟发性毒性作用
B. 过敏性反应
C. 高敏感性
D. 速发性毒性作用
E. 特异体质反应

正确答案：B。过敏性反应